光照患者左眼引起双侧瞳孔缩小，而光照右眼，双侧瞳孔均不缩小，损伤的结构是
A. 右视束
B. 右视神经
C. 左视束
D. 左视神经
E. 无

正确答案：B。右视神经

解析：一侧视神经受损时，信息传入中断，光照患侧眼的瞳孔，两侧瞳孔均不反应；但光照健侧眼的瞳孔，则两眼对光反射均存在，即双眼瞳孔缩小。该题患者左眼引起双侧瞳孔缩小，而光照右眼，双侧瞳孔均不缩小，应考虑右视神经（B对）受损，排除左侧视神经（D错）一侧视束损伤，光照健侧眼，患侧瞳孔缩小，因此排除左视束（C错）和右视束（A错）。